能治疗疝气、少腹痛的腧穴是
A. 隐白
B. 太白
C. 大敦
D. 大都
E. 关元

正确答案：C。大敦

解析：题干要求治疗疝气、少腹痛，当选肝经穴位，因为肝经“…循股阴，入毛中，环阴器，抵小腹…”，主要病候为腰痛，胸满，呃逆，遗尿，小便不利，疝气，少腹肿等症。 隐白、大都、太白为脾经穴位，不主治肝经病症（ABD错），关元，任脉穴，可治少腹疼痛，疝气，相比大敦不是首选（E错），只有大敦穴位于肝经主治少腹疼痛，疝气（C对）。